高磷血症对机体的影响中哪一项不存在？
A. 低钙血症
B. 异位钙化
C. 抑制肾α羟化酶
D. 低镁血症
E. 抑制骨的重吸收

正确答案：D。低镁血症

解析：血液钙磷乘积为一常数，高磷血症导致血钙降低（A对），高血磷可以通过抑制肾α羟化酶（B对）影响钙的重吸收（E对），出现异位钙化（B对）。钙和镁在肾小管中被重吸收时有相互竞争作用，血钙降低可使肾小管重吸收镁增多，故高磷血症不会导致低镁血症（D错，为本题正确答案）。